采用PEG修饰，增加其柔顺性和亲水性的脂质体是
A. 热敏脂质体
B. 前体脂质体
C. 免疫脂质体
D. pH敏感脂质体
E. 长循环脂质体

正确答案：E。长循环脂质体

解析：本题考查新型靶向脂质体。PEG修饰可增加脂质体的柔顺性和亲水性，从而降低与单核巨噬细胞的亲和力，延长循环时间，称为长循环脂质体（E对）。